10月患儿，已在当地医院诊断为佝偻病活动期，给予治疗，效果不好。为进一步判定诊断是否正确，不需要做下列哪些检查
A. 腕部X线摄片
B. 测血清钙、磷
C. 血常规
D. 体格检查
E. 骨密度

正确答案：C。血常规

解析：活动期（激期）除初期症状外，主要表现为骨骼改变和运动功能发育迟缓。骨骼改变往往在生长最快的部位最明显，故不同年龄有不同的骨骼表现。血生化及骨骼X线改变：血钙稍降低，血磷明显降低，钙磷乘积常低于30，碱性磷酸酶明显增高。X线检查干骺端临时钙化带模糊或消失，呈毛刷样，并有杯口状改变；骺软骨明显增宽，骨骺与干骺端距离加大；骨质普遍稀疏，密度减低，可有骨干弯曲或骨折。掌握“维生素D缺乏性佝偻病”知识点。